食品营养价值的取决因素是
A. 营养素的种类是否齐全
B. 营养素的数量是否充足
C. 营养素的比例是否适宜
D. 食品被人体消化吸收的程度
E. 以上都包括

正确答案：E。以上都包括